关于实施人类辅助生殖技术的伦理原则，不当的是
A. 知情同意的原则
B. 限制商品化的原则
C. 互盲和保密的原则
D. 维护供受双方利益的原则
E. 维护后代利益的原则

正确答案：B。限制商品化的原则